目前评价振动强度大小的最常用的物理量是
A. 时间
B. 位移
C. 速度
D. 加速度
E. 频率

正确答案：D。加速度